用炽灼残渣硫代乙酰胺法测定重金属时的温度是
A. 60～80℃
B. 100～110℃
C. 200～300℃
D. 500～600℃
E. 1000～1200℃

正确答案：D。500～600℃

解析：本题考查重金属检查法第二法炽灼后的硫代乙酰胺法。炽灼残渣用于重金属检查时，炽灼处理中，既应控制炽灼温度在500～600℃（D对），同时应控制炽灼时间。